分布于外耳道皮肤
A. 面神经
B. 迷走神经
C. 舌下神经
D. 前庭蜗神经
E. 舌咽神经

正确答案：B。迷走神经

解析：面神经（A错）主要传导耳部小块皮肤的浅感觉和面肌的本体感觉。迷走神经（B对）分布于硬脑膜、耳郭和外耳道的皮肤。舌下神经（C错）主要分布于舌内肌和大部分舌外肌。前庭蜗神经（D错）主要支配平衡觉和听觉。舌咽神经（E错）分布于咽、舌后1/3、咽鼓管和鼓室等处黏膜。